颈肿眼突，可诊断为
A. 肺胀
B. 瘿瘤
C. 瘟病
D. 痄腮
E. 发颐

正确答案：B。瘿瘤

解析：瘿瘤指颈前结喉处，单侧或双侧有肿块突起，或大或小，可随吞咽上下移动兼见眼球突出，称为瘿瘤。多因肝郁气结，痰凝血瘀，或因水土失调，痰气凝结所致。眼突而喘属肺胀（A错）。瘟病是指中医对各种急性热病的统称（C错）。痄腮以发热、耳下腮部漫肿疼痛为临床主要特征（D错）。发颐，是热病后余毒结于颐颌间引起的急性化脓性疾病，常发生于热病后期，颐颌部肿胀疼痛，张口受限，全身症状明显，重者可发生内陷（E错）。